男，45岁。近3个月自觉轻度乏力。母亲HBsAg（+）。实验室检査：血ALT420U/L，TBil64μmol/L，PTA88%，HBsAg（+），HBeAg（+），抗HBc（+），HBVDNA4.5x10⁵copies/ml。化验结果正常后的随访间隔时间最好是
A. 30天
B. 15天
C. 180天
D. 60天
E. 90天

正确答案：E。90天

解析：化验结果正常后的随访间隔时间最好是3个月（90天）（E对）。